高血钾症病人禁用的利尿药是
A. 氢氯噻嗪
B. 苄氟噻嗪
C. 布美他尼
D. 呋塞米
E. 氨苯蝶啶

正确答案：E。氨苯蝶啶

解析：低效利尿药，又称保钾利尿药。如氨苯蝶啶则通过抑制远曲小管和集合管的Na⁺通道，使Na⁺—K⁺交换减少，排Na⁺增加，也表现为留钾利尿。因此高血钾症病人禁用（E对）。